最早应用的AchE复活药的是
A. 碘解磷定
B. 氯解磷定
C. 双复磷
D. 阿托品
E. 毛果芸香碱

正确答案：A。碘解磷定

解析：碘解磷定（PAM-I）为最早应用的AchE复活药（A对）。